评价健康教育计划的最终目标是否实现是
A. 过程评价
B. 效果评价
C. 近期评价
D. 远期评价
E. 结局评价

正确答案：E。结局评价